患儿，男，6岁。突发咳喘哮鸣，气促，喉间痰鸣，咳痰清稀色白，形寒无汗，面色青灰，张口抬肩，舌苔薄白或白腻，脉浮滑。辨证为
A. 热性哮喘
B. 寒性哮喘
C. 肺气虚弱证哮喘
D. 脾气虚弱证哮喘
E. 肾虚不纳证哮喘

正确答案：B。寒性哮喘

解析：患儿突发咳喘哮鸣，气促，喉间痰鸣，咳痰清稀色白，形寒无汗，面色青灰，张口抬肩舌苔薄白或白腻，脉浮滑。素体阳虚，或外感风寒，内伤生冷，引动伏痰，则发为寒性哮喘（B对）。热性哮喘证候：咳喘哮鸣，声高息涌，痰稠色黄，发热面红，胸闷膈满，渴喜冷饮，小便黄赤，大便干燥或秘结，舌质红，舌苔黄腻，脉象滑数，指纹紫（A错）。痰邪恋肺，肺脾气虚证候：早晚轻喘或动则发喘，晨起痰咳，遇寒作嚏，自汗懒言，神疲纳差，大便黏腻不爽，舌质淡，苔白腻，脉沉滑，指纹淡（CD错）。 痰邪恋肺，肾虚不纳证候：病程长，喘促迁延不愈，动则喘甚，面白少华，形寒肢冷，尿频或小便清长，伴见咳嗽痰多，喉间痰鸣，舌质淡，舌苔白或腻，脉细弱，指纹淡滞（E错）。